下列除哪项外，均是经期延长血瘀证的主症
A. 经行8〜10天始净
B. 月经量少、色暗、有块
C. 小腹疼痛拒按
D. 腰酸腿软
E. 舌紫暗，脉弦涩

正确答案：D。腰酸腿软

解析：瘀血阻于冲任，新血难安，故经行时间延长，量或多或少（A对）。瘀血所致经期延长，月经量或多或少，瘀阻冲任，气血运行不畅，故经行色暗，有血块（B对）。瘀阻冲任，不通则痛，故小腹疼痛拒按（C对）。腰酸腿软为肾虚所致的症状（D错，为本题正确答案）。舌紫暗，脉弦涩符合血瘀证的舌脉（E对）。